地骨皮的原植物属于
A. 芸香科
B. 茄科
C. 樟科
D. 木兰科
E. 毛茛科

正确答案：B。茄科

解析：本题考查的是地骨皮的来源。地骨皮的原植物属于茄科（B对）。地骨皮：【来源】为茄科植物枸杞或宁夏枸杞的干燥根皮。来源于芸香科（A错）的中药有黄柏、关黄柏、白鲜皮、枳壳、吴茱萸等。来源于樟科（C错）的中药有肉桂、天然冰片等。来源于木兰科（D错）的中药有厚朴、辛夷、五味子、南五味子等。来源于毛茛科（E错）的中药有威灵仙、川乌、附子、白芍、赤芍、升麻等。